ADH释放的有效刺激主要是
A. 血浆晶体渗透压降低
B. 血浆晶体渗透压升高
C. 血浆胶体渗透压升高
D. 血浆胶体渗透压降低
E. 循环血量增加

正确答案：B。血浆晶体渗透压升高